患者，女，26岁，已婚孕36周余，小腿水肿，胸闷气短，疲乏无力，口淡纳少，腹胀便溏，舌胖嫩边有齿痕，苔薄白，脉滑缓无力。检查：水肿+，血压130/90mmHg（17.33/11.99kPa）。治疗应首选
A. 降压药肼苯达嗪
B. 利尿药氨苯蝶啶
C. 补气方四君子汤
D. 健脾行水方白术散
E. 化气行水方真武汤

正确答案：D。健脾行水方白术散

解析：患者已婚孕36周余，血压130/90mmHg17.33/11.99kPa，为妊娠期高血压。小腿水肿，胸闷气短，疲乏无力，口淡纳少，腹胀便溏舌胖嫩边有齿痕，是由于脾虚运化失职，可致水湿停聚，加之胎儿长大，阻碍气机，不能敷布津液、水湿，泛溢肌肤则为水肿，选方白术散（D对）。降压药肼苯达嗪能直接扩张周围血管，以扩张小动脉为主，降压作用强，降低外周总阻力而降压，可改善肾、子宫和脑的血流量（A错）。利尿药氨苯蝶啶心力衰竭、肝硬化及慢性肾炎引起的水肿和腹水，以及糖皮质激素治疗过程中发生的水钠潴留。常与排钾利尿药合用（B错）。补气方四君子汤功用 益气温阳。主治 虚损劳怯，元气不足证（C错）。化气行水方真武汤主治肾阳虚衰兼水湿泛溢之证（E错）。